分泌激素促进骨的生长发育
A. 位于腹膜后隙内
B. 左侧呈半月形
C. 垂体前叶
D. 垂体后叶
E. 胸腺

正确答案：C。垂体前叶

解析：骨的生长发育是由生长激素调控的，幼年时生长激素分泌不足会导致垂体性侏儒症；如果生长激素分泌过多，在骨骼发育成熟前则引起巨人症，在骨骼发育成熟后可引起肢端肥大症。一般人体激素多由垂体前叶（C对）分泌，包括生长激素；而垂体后叶分泌的激素有抗利尿激素与催产素（又合称垂体后叶素）。